关于牙齿数目异常，下列正确的说法是
A. 表现为数目不足与数目过多
B. 牙齿数目不足包括先天缺牙和后天缺牙
C. 先天性无牙症是中胚叶发育不全的表现
D. 智齿是最常见的多生牙
E. 先天缺牙一般不发生在乳牙

正确答案：A。表现为数目不足与数目过多

解析：本题考查牙齿数目异常。牙数目异常主要是指先天性缺额牙和额外牙，即数目不足与数目过多（A对）。牙齿数目不足是指未曾在口内发生的牙，而后天牙缺失是由于龋病、牙周病、外伤、颌骨疾病、发育性疾病等原因造成患牙的不可保留或缺失，不属于牙齿数目异常（B错）。牙齿的发育来自外胚间叶组织（C错）。智齿不属于多生牙，多生牙最多见的是“正中牙”，位于上颌两中切牙之间（D错）。先天缺牙也可发生在乳牙列（E错）。